医患关系的发展趋势不包括
A. 医患要求的“多元化”趋势
B. 医患交往的“经济化”趋势
C. 医患关系结构的“人机化”趋势
D. 医患关系调节方式上的“社会化”趋势
E. 医患关系调节方式上的“法制化”趋势

正确答案：D。医患关系调节方式上的“社会化”趋势